某男性，玻璃厂碎石工，年龄40岁，工龄10年以上。近来主诉咳嗽，胸闷，气短，X线胸片呈现肺纹理增加，并伴有块状阴影。此工人最可能患何种尘肺
A. 石棉肺
B. 煤肺
C. 铝肺
D. 矽肺
E. 煤矽肺

正确答案：D。矽肺

解析：本题考查矽肺病人症状和X线表现。矽肺（D对ABCE错）病人随着病情的进展，可出现胸闷、气短、胸痛、咳嗽、咳痰等症状和体征。X线胸片可呈毛玻璃状和（或）网状及斑片状阴影，可为对称或不对称性，有时可见支气管充气征。